患者，女性，65岁，被动吸烟40年。因高调金属音般干咳、消瘦乏力1个月，血痰2天伴喘鸣气短就医。经临床与胸部CT诊断为左上肺癌，下一步检查最重要的是明确
A. 既往疾病史及家族癌症史
B. 目前的心肺功能及肝肾功能状况
C. 目前机体的免疫状态
D. 无合并阻塞性肺炎
E. 肺癌的组织学类型和分期

正确答案：E。肺癌的组织学类型和分期

解析：该患者当前最重要的是应尽快明确肺癌的组织学类型和分期，这样才能够根据当前的身体状况制订治疗方案，其他各项均不是确定肺癌治疗方案的关键因素。掌握“肺癌”知识点。